医师在执业活动中不属于应当履行的义务是
A. 宣传普及卫生保健知识
B. 尊重患者隐私权
C. 人格尊严、人身安全不受侵犯
D. 努力钻研业务，及时更新知识
E. 爱岗敬业，努力工作

正确答案：C。人格尊严、人身安全不受侵犯